患者关节疼痛重着，四肢沉重，头重如裹，其病因是
A. 风邪
B. 寒邪
C. 暑邪
D. 湿邪
E. 痰饮

正确答案：D。湿邪

解析：湿邪致病，常出现以沉重感及附着难移为特征的临床表现，如头身困重、四肢酸楚沉重并且附着难移等。湿邪外袭肌表，困遏清阳，清阳不升，则头重如束布帛（D对）。寒邪（B错）为阴邪，易伤阳气，寒性凝滞，收引。暑邪（C错）为阳邪，炎热，升散，易扰心神，易伤津耗气，多挟湿。痰饮（E错）是人体水液代谢障碍所形成的病理产物，可以阻滞气血运行，影响水液代谢，蒙蔽心神。